抗乙型肝炎病毒的药品是
A. 伊曲康唑
B. 利巴韦林
C. 奥司他韦
D. 拉米夫定
E. 金刚烷胺

正确答案：D。拉米夫定

解析：本题考查抗乙肝病毒药。抗乙型肝炎病毒的药品是拉米夫定（D对）。抗乙型肝炎病毒药有拉米夫定、恩替卡韦、干扰素、阿德福韦酯等。伊曲康唑（A错）为三唑类抗真菌药。利巴韦林（B错）、奥司他韦（C错）、金刚烷胺（E错）为抗流感病毒药。